表示药物安全性的是
A. 药物的效能
B. 治疗指数
C. 半数有效量
D. 最小有效剂量
E. 极量

正确答案：B。治疗指数

解析：治疗指数是LD₅₀/ED₅₀的比值，其中ED₅₀代表半数有效量（C错），即能引起50%实验动物出现阳性反应时的药物的量，如效应为死亡，则成为半数致死量，用LD₅₀表示，治疗指数越大，药物安全性就越大（B对）。在一定范围内，随剂量或浓度的增加，药物的效应也增加，但效应增加到一定程度后，若继续增加药物浓度或剂量而其效应不再继续增加，这一药理效应的极限称为效能（A错）。最小有效量或最低有效浓度即刚能引起效应的最小药量或最小药物浓度，亦称为阈剂量或阈浓度（D错）。引起最大效应而不出现中毒的剂量称极量（E错）。